女，30岁，4小时前口服敌百虫。查体：躁动，瞳孔缩小，肺部湿啰音。错误的处置是
A. 应用阿托品
B. 应用解磷定
C. 吸氧
D. 应用抗生素
E. 地西泮肌肉注射

正确答案：D。应用抗生素

解析：患者口服敌百虫（有机磷农药）后出现躁动，肺部湿啰音及瞳孔缩小，在促进毒物排出的同时宜使用胆碱酯酶复能药以及胆碱受体拮抗药进行治疗，阿托品（A对）属于胆碱酯酶拮抗药，解磷定（B对）属于胆碱酯酶复活药。患者双肺出现湿罗音，说明呼吸道分泌物增多，应保持呼吸道通畅，吸氧（C对），必要时给予机械通气。患者出现躁动不安，可予以镇静治疗，常用地西泮肌肉注射（E对）。有机磷农药中毒时，抗生素对有机磷农药中毒症状无直接治疗作用（D错，为本题的正确答案）。请注意，有机磷农药中毒呼吸道分泌物增多可并发肺部感染，可用抗生素治疗感染，本患者有一定的肺部感染可能，D选项并不严谨。